氢氧化铝治疗消化性溃疡病的机制是
A. 抑制胃壁细胞H⁺泵
B. 阻断H₂受体
C. 中和胃酸
D. 抗幽门螺杆菌
E. 阻断M1胆碱受体

正确答案：C。中和胃酸

解析：抗酸药为无机弱碱性物质，口服后能中和胃酸（C对），抑制胃蛋白酶活性，降低或消除胃酸、胃蛋白酶对胃、十二指肠黏膜的侵蚀和对溃疡面的刺激，缓解疼痛和促进溃疡面愈合。常用的抗酸药物有氢氧化镁、三硅酸镁、氧化镁、氢氧化铝等。